下列各项不符合肺心病的体征是
A. 肝颈静脉回流征阳性
B. 颈静脉怒张
C. 剑突下心脏搏动增强
D. 肺动脉瓣区第二心音亢进
E. 心脏浊音界向左下扩大

正确答案：E。心脏浊音界向左下扩大

解析：肺动脉高压的形成是肺源性心脏病发病的先决条件，因此可出现肺动脉高压的特征性临床表现肺动脉瓣区第二心音亢进（D对）。心脏浊音界向左下扩大（E错，为本题正确答案）为左心室肥大的表现。慢性肺源性心脏病右心室肥厚时可有剑突下心脏搏动增强（C对）。部分病人因肺气肿使胸内压升高，阻碍腔静脉回流，可有颈静脉怒张（B对）。肝颈静脉回流征是指右心衰竭的病人，如按压其肿大的肝脏，则颈静脉充盈更为明显。慢性肺源性心脏病失代偿期右心衰竭，肝脏淤血，可出现肝颈静脉回流征阳性（A对）。